代谢性碱中毒的特征是
A. HCO₃⁻下降，pH下降，PaCO₂正常
B. HCO₃⁻上升，pH上升，PaCO₂正常
C. HCO₃⁻下降，pH上升，PaCO₂下降
D. HCO₃⁻正常，pH下降，PaCO₂下降
E. HCO₃⁻正常，pH下降，PaCO₂上升

正确答案：B。HCO₃⁻上升，pH上升，PaCO₂正常

解析：代谢性碱中毒的特征是HCO₃⁻上升，pH上升，PaCO₂正常。HCO₃⁻、AB、SB、BB、BE增加即可考虑：如能除外呼吸因素的影响，CO₂CP高有助于诊断（B对）。